黄芩、黄连、黄柏均具备的功效有
A. 清热
B. 燥湿
C. 泻火
D. 解毒
E. 退虚热

正确答案：A、B、C、D。清热；燥湿；泻火；解毒

解析：本题考查的是黄芩、黄连、黄柏的功效。黄芩、黄连、黄柏均具备的功效有清热（A对）、燥湿（B对）、泻火（C对）与解毒（D对）。黄芩：【功效】清热燥湿，泻火解毒，止血，安胎。黄连：【功效】清热燥湿，泻火解毒。黄柏：【功效】清热燥湿，泻火解毒，退虚热（E错）。